治疗鹅口疮心脾积热证，应首选的方剂是：
A. 知柏地黄丸
B. 泻心导赤散
C. 银翘散
D. 清热泻脾散
E. 黄连温胆汤

正确答案：D。清热泻脾散

解析：鹅口疮是以口腔、舌上蔓生白屑为主要临床特征的一种口腔疾病。鹅口疮心脾积热证治当以清心泻脾，清热泻脾散用黄连、栀子清心泄热；黄芩、石膏散脾经郁热，生地黄清热凉血；竹叶、灯心清热降火，导热下行，甘草调和诸药，诸药合用共奏清热泻脾之效（D对）；知柏地黄丸用来治疗鹅口疮虚火上浮证（A错）；银翘散（C错）、黄连温胆汤（E错）、泻心导赤散（B错）不针对治疗鹅口疮。